生物有效剂量是
A. 个体暴露量
B. 靶部位的污染物量
C. 尿液中污染物的含量
D. 血液中污染物的含量
E. 血液中污染物的代谢产物含量

正确答案：B。靶部位的污染物量

解析：本题考查生物有效剂量。生物有效剂量指经吸收、代谢活化、转运、最终到达器官组织、细胞、亚细胞或分子等靶部位或替代性靶部位的污染物量（B对ACDE错）。